既是络穴，又是八脉交会穴的腧穴是
A. 太渊
B. 合谷
C. 后溪
D. 内关
E. 阳池

正确答案：D。内关

解析：太渊为手太阴肺经的输穴、原穴、同时也是八会穴之脉会（A错）。合谷为手阳明大肠经的原穴（B错）。后溪为手太阳小肠经的输穴，同时也是八脉交会穴（通与督脉）（C错）。内关为手厥阴心包经的络穴，同时也是八脉交会穴（通于阴维脉）（D对）。阳池为手少阳三焦经的原穴（E错）。记忆：八脉交会穴背诵八脉交会八穴歌。络穴趣记，公孙在内外关这样偏沟里，缺少支持，为了丰隆飞向光明。公孙、内关、外关、偏历、蠡沟、通里、列缺、支正、丰隆、飞扬、光明。